关于急性毒性说法正确的是
A. 是指机体瞬间内接触外来化合物在短期内所引起的毒效应
B. 是指机体一次大剂量接触外来化合物在短期内所引起的毒效应
C. 是指机体一次大剂量接触外来化合物后引起快速而猛烈的中毒效应
D. 是指机体连续数次接触化合物所引起的中毒效应
E. 毒效应观察包括一般行为改变、外观改变、大体形态变化及死亡效应

正确答案：E。毒效应观察包括一般行为改变、外观改变、大体形态变化及死亡效应